欲研究新法接生是否能减少新生儿窒息的发生率，选择某市级医院为试验组，进行新法接生，选择某县级医院为对照组，用常规方法接生，该方案
A. 可行
B. 不可行，未使用盲法观察
C. 不可行，未随机化
D. 不可行，对照设立不当，可比性差
E. 不可行，样本含量太小

正确答案：D。不可行，对照设立不当，可比性差